关于下颌下腺炎的叙述哪项是错误的
A. 多为涎石造成唾液排出受阻继发感染所致
B. 反复发作者下颌下腺可呈硬结性肿块
C. 双手触诊应从导管前部向后进行
D. 少数涎石X线片可能不显影
E. 腺内涎石需做下颌下腺摘除术

正确答案：C。双手触诊应从导管前部向后进行

解析：本题考查下颌下腺炎。对存在炎症的下颌下腺，进行双手触诊检查时，应沿导管从后向前（C错，为本题的正确答案）进行，若从导管前部向后进行，会使导管口的细菌沿导管逆行进入下颌下腺内部，使炎症扩散。唾液腺结石常使唾液排出受阻，并继发感染（A对），造成下颌下腺急性或反复发作的。下颌下腺炎症反复发作时，导管口结石堵塞导致腺体内唾液滞留，钙盐沉积，形成腺内结石，使下颌下腺呈硬结性肿块（B对）。钙化程度较低的唾液腺结石，即所谓阴性唾液腺结石，在X线平片上难以显示（D对）。腺内涎石很难通过取石术、碎石术取出，需行腺体切除术（E对）。